左下6全冠修复，试戴边缘密合，舌尖受力舌侧脱位的原因是
A. 摩擦固位不够
B. 舌尖咬合高
C. 邻接松
D. 未完全就位
E. 预备体固位形聚合度大

正确答案：B。舌尖咬合高

解析：本题考查修复体戴入后出现的问题。左下6全冠修复，试戴边缘密合，舌尖受力舌侧脱位的原因是舌尖咬合高（B对）。舌尖咬合高引起舌尖的早接触，引起咬合不良，从而导致修复体的舌侧脱位。摩擦固位不够（A错）指患者在休息状态下，出现修复体的松动脱落。邻接松（C错）主要引起食物嵌塞等。未完全就位（D错）表现为修复体边缘不密合、咬合不良等，与题干不符。预备体固位形聚合大度（E错）易造成修复体的脱落，与牙尖无密切关联，因此与题干不符。